女性，30岁。在颈丛麻醉下施行了甲状腺腺瘤切除术，手术顺利。病人的拆线时间为术后
A. 2～3天
B. 4～5天
C. 6～7天
D. 8～9天
E. 10～12天

正确答案：B。4～5天

解析：甲状腺腺瘤切除术为颈部手术，拆线时间在术后4～5天（B对）。缝线的拆线时间如下：一般头、面、颈部在术后4～5日拆线，下腹部、会阴部在术后6～7日拆线，胸部、上腹部、背部、臀部手术7～9日拆线，四肢手术10～12天拆线（近关节处可适当延长），减张缝合14日拆线。